发热是体温调定点
A. 上移，引起的调节性体温升高
B. 下移，引起的调节性体温升高
C. 上移，引起的被动性体温升高
D. 下移，引起的被动性体温升高
E. 不变，引起的诃节性体温升高

正确答案：A。上移，引起的调节性体温升高

解析：由于致热原的作用使体温调定点上移而引起调节性体温升高（A对）称为发热。